中年妇女乳头血性溢液应首先考虑
A. 乳管内乳头状瘤
B. 乳腺囊性增生症
C. 乳腺纤维腺瘤
D. 炎性乳癌
E. 乳腺硬癌

正确答案：A。乳管内乳头状瘤

解析：中年妇女乳头血性溢液应首先考虑乳管内乳头状瘤（A对）。本病好发于40～50岁的经产妇，75%的病例瘤体位于大乳管近乳头的壶腹部，瘤体通常很小，带蒂而有绒毛，且有很多薄壁的血管，容易出血，产生血性溢液。乳腺囊性增生症（P241）（B错）主要表现为乳房胀痛及肿块，仅少数病人有乳头溢液，多为浆液性或浆液血性液体。乳腺纤维腺瘤（P242）（C错）一般仅表现为乳腺单发肿块，无乳头溢液。炎性乳癌（P243）（D错）表现为病变部位皮肤发红、水肿、增厚、粗糙、表面温度升高，无乳头溢液。乳腺硬癌（D错）属于浸润性非特殊癌，癌实质细胞数量少于间质细胞数量，无乳头溢液。